提供虚假材料申请药品广告审批，取得药品广告批准文号的，药品广告审查机关在发现后，应撤销该药品广告批准文号并给予的处罚包括
A. 3年内不受理该企业的同类药品广告审批申请
B. 1年内不受理该企业该品种的药品广告审批申请
C. 1年内不受理该企业的所有药品广告审批申
D. 3年内不受理该企业该品种的药品广告审批申

正确答案：A。3年内不受理该企业的同类药品广告审批申请

解析：本题考查违反药品广告管理的处罚。提供虚假材料申请药品广告审批，取得药品广告批准文号的，药品广告审查机关在发现后，应撤销该药品广告批准文号并给予的处罚包括3年内不受理该企业该品种的药品广告审批申（A对）。违反药品广告管理以不当方式获得批准文件的处罚：隐瞒真实情况或者提供虚假材料申请药品、医疗器械、保健食品和特殊医学用途配方食品广告审查的；或者以欺骗、贿赂等不正当手段取得药品、医疗器械、保健食品和特殊医学用途配方食品广告批准文号的，按照《广告法》第六十五条处罚，广告审查机关不予受理或者不予批准，予以警告，一年内不受理该申请人的广告审查申请（BC错）；以欺骗、贿赂等不正当手段取得广告审查批准的，广告审查机关予以撤销，处十万元以上二十万元以下的罚款，三年内不受理该申请人的广告审查申请（D错）。